恶寒发热并见，常见的病症是
A. 虚证
B. 实证
C. 表证
D. 里证
E. 寒证

正确答案：C。表证

解析：本题考查表里证鉴别要点。外感病中，发热恶寒同时并见者属表证（C对）。虚证指人体阴阳、气血、津液、精髓等正气亏虚，而邪气不著，表现为不足、松弛、衰退特 征的各种证候（A错）。实证指人体感受外邪，或疾病过程中阴阳气血失调，体内病理产物蓄积，以邪气盛、正气不 虚为基本病理，表现为有余、亢盛、停聚特征的各种证候（B错）。里证的证候特征是无新起恶寒 发热并见，以脏腑症状为主要表现，但热不寒或但寒不热者属里证（D错）。寒证是指感受寒邪，或阳虚阴盛所表现的具有冷、凉特点的证候，并不是恶寒发热并见（E错）。